患者，女，45岁，常有上腹部饱胀、恶心，食欲不振等消化不良症状。宜选用的药物
A. 复方阿嗪米特肠溶片
B. 奥美拉唑肠溶胶囊
C. 蒙脱石散
D. 干酵母片
E. 诺氟沙星胶囊

正确答案：D。干酵母片

解析：本题考查干酵母片。该患者宜选用的药物是干酵母片（D对）。对食欲减退者可服用增加食欲药，如口服维生素B₁、维生素B₆或口服干酵母片，一次0.5～2g，一日3～4次。复方阿嗪米特肠溶片（A错）用于因胆汁分泌不足或消化酶缺乏而引起的症状。奥美拉唑肠溶胶囊（B错）用于胃溃疡、十二指肠溃疡、应激性溃疡、反流性食管炎和卓-艾综合征（胃泌素瘤）。蒙脱石散（C错）用于成人及儿童急、慢性腹泻。干诺氟沙星胶囊（E错）用于敏感菌所致的尿路感染、淋病、前列腺炎、肠道感染和伤寒及其他沙门菌感染。